诊断甲状腺功能亢进（Graves病）最有价值的体征是
A. 皮肤湿润多汗、手颤
B. 甲状腺肿大伴震颤和血管杂音
C. 阵发性心房纤颤
D. 收缩压升高，舒张压降低，脉压增大
E. 窦性心动过速

正确答案：B。甲状腺肿大伴震颤和血管杂音

解析：甲状腺肿大伴震颤和血管杂音为诊断GD的必备条件，故其为诊断甲状腺功能亢进（Graves病）最有价值的体征（B对）。皮肤湿润多汗、手颤（A错）、阵发性心房纤颤（C错）、收缩压升高，舒张压降低，脉压增大（D错）、窦性心动过速（E错）都为Graves病的体征，但不能作为确诊体征。